心理活动或意识对一定对象的指向或集中的现象是
A. 注意
B. 人格
C. 记忆
D. 情感
E. 想象

正确答案：A。注意

解析：本题考查认知过程-注意。心理活动或意识对一定对象的指向或集中的现象是注意（A对）。人格（B错）是指一个人的整个精神面貌，具有一定倾向性的、稳定的心理特征的总和。记忆（C错）是通过对客观事物的感知与识别而获得事物的信息和编码，并在头脑中留下映象的过程。情感（D错）是指人们对客观事物是否符合自身需要的态度的体验，是个体对当前所面临的事物与正在进行的活动或已形成的观点之间的关系的体验和反映。想象（E错）是对大脑中已有表象进行加工改造，形成新形象的过程。